在丙酸睾酮的红外吸收光谱中，1615cm⁻¹是
A. 酮νC=O
B. 烯νC=C
C. 烷基ν-CH
D. 羟基νO-H
E. 烯ν=C-H

正确答案：B。烯νC=C

解析：本题考查红外吸收光谱。当峰位为1670～1500cm⁻¹时，所对应的振动形式为νC=C（B对），对应到丙酸睾酮，则其1615cm⁻¹处的归属基团或化学键为烯。酮νC=O（A错）所对应的峰位是1900～1650cm⁻¹。烷基ν-CH（C错）所对应的峰位是3000～2700cm⁻¹。羟基νO-H（D错）所对应的峰位是3750～3000cm⁻¹，烯ν=C-H（E错）所对应的峰位是3300～3000cm⁻¹。